临床患者口出酸臭气，其原因是
A. 食积
B. 胃热
C. 胃痛
D. 胃寒
E. 龋齿

正确答案：A。食积

解析：口气酸臭，兼见食少纳呆，脘腹胀满者，多属食积胃肠（A对）。口气臭秽属于胃热上蒸于口（B错）。胃痛，多由外感寒邪、饮食所伤、情志不畅和脾胃素虚等病因而引发（C错）。寒滞胃肠则见口淡不渴或口泛清水（D错）。口气奇臭难闻，牙眼腐烂者，为牙疳，牙疳又称为龋齿（E错）是由口腔多种因素复合作用所导致的牙齿硬组织进行性病。